哮喘急性发作首选的治疗药物是
A. 短效β₂受体激动剂
B. 白三烯受体阻断剂
C. 吸入性糖皮质激素
D. 磷酸二酯酶抑制剂
E. M胆碱受体阻断剂

正确答案：A。短效β₂受体激动剂

解析：本题考查哮喘急性发作首选药。β₂受体激动剂是控制哮喘急性发作的首选药。常用的短效β₂受体激动剂（A对）有沙丁胺醇和特布他林，平喘作用维持时间4～6h，是缓解轻、中度急性哮喘症状的首选药。白三烯受体阻断剂（B错）适用于哮喘的长期治疗和预防，包括预防白天和夜间的哮喘症状，治疗对阿司匹林敏感的哮喘以及预防运动诱发的支气管收缩，减轻过敏性鼻炎引起的症状。吸入性糖皮质激素（C错）适用于重症哮喘（哮喘持续状态）、慢性反复发作的哮喘、激素依赖性哮喘。磷酸二酯酶抑制剂（D错）代表药物有茶碱，适用于慢性哮喘，尤其是夜间发作的哮喘患者。M胆碱受体阻断剂（E错）为阿托品衍生物，能选择性拮抗M₃受体，扩张支气管平滑肌，缓解哮喘症状，适用于COPD的治疗。